用米炒的是
A. 斑蝥
B. 决明子
C. 白术
D. 马钱子
E. 水蛭

正确答案：A。斑蝥

解析：本题考查的是适合米炒的药材。用米炒的是斑蝥（A对）。斑蝥：【炮制方法】处方用名有斑蝥、炒斑蝥、米炒斑蝥。白术（C错）：【炮制方法】处方用名有白术、土炒白术、麸炒白术。马钱子（D错）：【炮制方法】处方用名有马钱子、制马钱子。水蛭（E错）：【炮制方法】处方用名有水蛭、制水蛭、炒水蛭。决明子（B错）的炮制方法，2022年考试指南未明确说明。